不属鼻咽的结构是
A. 咽鼓管圆枕
B. 咽隐窝
C. 咽鼓管咽口
D. 咽扁桃体
E. 腭扁桃体

正确答案：E。腭扁桃体

解析：咽鼓管圆枕(A错)、咽隐窝(B错)、咽鼓管咽口(C错)、咽扁桃体(D错)均为鼻咽的结构，腭扁桃体(E对)位于口咽部。